妇女带下色白，清稀如涕，无臭味，多属
A. 脾虚气弱
B. 冲任亏虚
C. 寒湿下注
D. 肝经郁热
E. 湿热下注

正确答案：C。寒湿下注

解析：带下色白量多，质稀如涕，无臭味，多因脾肾阳虚，寒湿下注所致（C对）。脾虚气弱（A错）、冲任亏虚（B错）多引起月经异常。湿热下注多引起黄带（E错）。肝经郁热多引起赤白带（D错）。